满足下列何种条件，泊松分布可认为近似正态分布
A. 样本率p不接近于0或1
B. n足够大
C. λ≥20
D. 方差等于均数
E. 总体均数不大

正确答案：C。λ≥20